人类辅助生殖技术的伦理原则是
A. 知情同意的原则
B. 社会公益原则
C. 严防商业化的原则
D. 伦理监督的原则
E. 以上说法均正确

正确答案：E。以上说法均正确

解析：人类辅助生殖技术的伦理原则：有利于患者的原则、知情同意的原则、保护后代的原则、社会公益原则、保密原则、严防商业化的原则、伦理监督的原则。掌握“人类生殖技术伦理”知识点。